石膏、龙骨等中药与洋地黄类药物联用会
A. 产生络合物，妨碍吸收
B. 增强毒性
C. 产生沉淀，降低疗效
D. 抑制药物活性
E. 引发药源性肝病

正确答案：B。增强毒性

解析：本题考查的是中西药不合理联用的常见例子。石膏、龙骨等中药与洋地黄类药物联用会增强毒性（B对）。含钙较多的中药或中成药，如石膏、龙骨、牡蛎、珍珠、蛤壳及瓦楞子等，不可与洋地黄类药物合用，因钙离子为应激性离子，能增强心肌收缩力，抑制Na⁺，K⁺-ATP酶活性（也可以说与强心苷有协同作用），从而增强洋地黄类药物的作用和毒性。产生络合物，妨碍吸收（A错）为含钙、镁、铁等金属离子的中药与四环素类抗生素或左旋多巴联用的不良反应。含钙、镁、铁等金属离子的中药，如石膏、瓦楞子、牡蛎、龙骨、海螵蛸、石决明、赭石、明矾等及其中成药不能与四环素类抗生素或左旋多巴联用，因四环素类抗生素可与金属离子形成络合物，而不易被胃肠道吸收，降低疗效；左旋多巴中有游离酚羟基，遇金属离子则会产生络合反应，生成左旋多巴与钙、铝、镁、铁、铋的络合物，影响其吸收，从而降低左旋多巴的生物效应。产生沉淀，降低疗效（C错）为含鞣质较多的中药或中成药与米痛（去痛片）、酚氨咖敏片（克感敏）、酚氨咖敏颗粒等或含金属离子的西药联用的不良反应。含鞣质较多的中药或中成药，不可与索米痛（去痛片）、酚氨咖敏片（克感敏）、酚氨咖敏颗粒等同服，因同服后可产生沉淀而不易被机体吸收。亦不可与含金属离子的西药如钙剂、铁剂、氯化钴合用，因同服后可在回盲部结合，生成沉淀，致使机体难于吸收而降低药效。抑制药物活性（D错）为金银花、连翘、黄芩、鱼腥草等及其中成药与菌类制剂联用的不良反应。金银花、连翘、黄芩、鱼腥草等及其中成药，不宜与菌类制剂如乳酶生、促菌生等联用，因金银花、连翘、黄芩、鱼腥草等及其中成药具有较强抗菌作用，服用后在抗菌的同时，还能抑制或降低西药菌类制剂的活性。引发药源性肝病（E错）为对肝脏有一定毒性的中药及中成药与对肝脏有一定毒性的西药联用的不良反应。含水合型鞣质而对肝脏有一定毒性的诃子、五倍子、地榆、四季青等，以及含有这些药物的中成药，不能与对肝脏有一定毒性的西药四环素、利福平、氯丙嗪、异烟肼、依托红霉素等联用，因联用后会加重对肝脏的毒性，导致药源性肝病的发生；黄药子对肝脏有一定毒性，亦不可与上述对肝脏有一定毒性的西药联用，以免引发药源性肝病。